主含黄酮类化学成分的药材有
A. 淫羊藿
B. 大青叶
C. 蓼大青叶
D. 番泻叶
E. 罗布麻叶

正确答案：A、E。淫羊藿；罗布麻叶

解析：本题考查的是淫羊藿与罗布麻叶的有效成分。主含黄酮类化学成分的药材有淫羊藿（A对）、罗布麻叶（E对）。含黄酮类及其苷类的中药材有葛根、黄芩、槲寄生、桑白皮、银杏叶、侧柏叶、槐米、红花、蒲黄、雪莲、石韦、淫羊藿、罗布麻叶等。大青叶（B错）【成分】叶含菘蓝苷约1%。另自植物中分离得到芥苷、新芥苷黑芥子苷、游离吲哚醇及氧化酶、十八酸等。菘蓝苷易水解形成靛蓝、靛玉红。蓼大青叶（C错）【成分】新鲜全草含靛青苷，酸水解后生成吲哚酚，在空气中被氧化成靛蓝。番泻叶（D错）【成分】狭叶番泻叶含番泻苷A及B、番泻苷C及D、芦荟大黄素双蒽酮苷、大黄酸葡萄糖苷、芦荟大黄素葡萄糖苷及少量大黄酸、芦荟大黄素。